手外伤治疗的最终目的是
A. 早期彻底清创
B. 一期闭合伤口
C. 骨折解剖复位固定
D. 组织修复
E. 恢复手部运动功能

正确答案：E。恢复手部运动功能

解析：手外伤治疗的最终目的是恢复手部运动功能（E对）。而早期彻底清创（A错）、一期闭合伤口（B错）、骨折解剖复位固定（C错）及组织修复（D错）均为手外伤治疗原则。